翼腭窝部位的肿瘤，常常会直接压迫
A. 翼内肌神经
B. 翼外肌神经
C. 上牙槽前神经
D. 上牙槽中神经
E. 上牙槽后神经

正确答案：E。上牙槽后神经

解析：本题考查翼腭窝部位的肿瘤会直接压迫的神经。翼腭窝位于颧弓下方的深面，由上颌骨、颧骨、蝶骨围成，内有上颌神经的分支经过，上牙槽后神经（E对）在翼腭窝内自上颌神经干发出，因而常受到翼腭窝肿瘤的压迫。翼内肌神经（A错）和翼外肌神经（B错）发自下颌神经，未达翼腭窝。上牙槽前神经（C错）和上牙槽中神经（D错）在眶下管内发自眶下神经，虽经过翼腭窝，但不会被直接压迫。